中风脱证取
A. 中极、气海
B. 神阙、百会
C. 神阙、关元
D. 水沟、足三里
E. 水沟、十二井穴

正确答案：C。神阙、关元

解析：中风基本病机是脏腑阴阳失调，气血逆乱，上扰清窍，窍闭神匿，神不导气。脱证治宜醒脑开窍固脱，结合中风取穴原则，脱证应选取神阙、关元，可醒脑开窍、调神固脱（C对）。关元、气海用大艾炷灸，神阙用隔盐灸，不计壮数，以汗止、脉起、肢温为度。